关于牙齿的“松动度”的检查，下列说法错误的是
A. Ⅰ度松动：唇（颊）舌（腭）向松动
B. Ⅱ度松动：唇（颊）舌（腭）向松动和近远中向松动
C. Ⅲ度松动：只限于唇（颊）舌（腭）向、近远中向松动
D. Ⅱ度松动：松动幅度1～2mm之间
E. Ⅰ度松动：松动幅度小于1mm

正确答案：C。Ⅲ度松动：只限于唇（颊）舌（腭）向、近远中向松动

解析：本题考查牙髓病检查方法及诊断程序。牙齿松动度检查，按不同的动度记录为：Ⅰ度松动：唇（颊）舌（腭）向松动（A对），或松动幅度小于1mm（E对）；Ⅱ度松动：唇（颊）舌（腭）向松动和近远中向松动（B对），或松动幅度1～2mm之间（D对）；Ⅲ度松动：唇（颊）舌（腭）向、近远中向及垂直向均松动，或松动幅度大于2mm（C错，为本题正确答案）。